患者，女，68岁。因心力衰竭入院，拟用地高辛口服治疗，每日0.25mg。已知地高辛半衰期为36小时，达到稳定的血药浓度约需
A. 2～3天
B. 6～7天
C. 9～10天
D. 12～14天
E. 16～18天

正确答案：B。6～7天

解析：半衰期t1/2一般指血药浓度下降一半所需要的时间，也称为血浆半衰期，临床上连续多次给药，若每隔1个t1/2用药一次，则经过4-6个t1/2后体内药量可达稳态水平的93.5%～98.4%，这种相对稳定的水平称为稳态血药浓度Css，此时给药量与消除量达到平衡，地高辛半衰期为36小时，其达到稳定血药浓度的时间为6-9天（B对）。